不是决定孕妇分娩因素的是
A. 产力
B. 医生的水平
C. 产道
D. 胎儿
E. 精神心理因素

正确答案：B。医生的水平